为了提高碳水化合物在膳食中的供能比例，应提高摄入的食物的种类是
A. 谷类
B. 肉类
C. 蛋类
D. 蔬菜
E. 水果

正确答案：A。谷类